下列不属于下颌阻生第三磨牙拔除术的适应证的是
A. 阻生齿有龋坏，引起第二磨牙牙体、牙周病变者
B. 反复引起冠周炎
C. 因正畸需要拔除
D. 阻生齿（牙合）面浅龋，有对颌牙
E. 可能为颞下颌关节紊乱病的病因

正确答案：D。阻生齿（牙合）面浅龋，有对颌牙

解析：阻生齿（牙合）面浅龋，有对颌牙者，可考虑进行充填治疗。掌握“阻生牙拔除术”知识点。